男性，18岁学生，不出门怕见人，不去上课，纠缠父母出钱给自己做美容手术半年。原因是半年来反复照镜子发现自己的鼻子比以前变大了，难看了。说班上的同学都讥笑他，出门就感觉别人在说他，别人的眼光看他时很特别，能使他头痛。父母不愿意出钱就说父母不关心他，父母不是亲生的，曾说要去做亲子鉴定。判断一种抗精神病药是否有效至少要足量使用的时间是
A. 6周
B. 5周
C. 8周
D. 7周
E. 8周

正确答案：A。6周

解析：判断一种抗精神病药是否有效需要4～6周（A对），该内容属于常考数据，请考生牢记。